下列哪一项不属于养生的方法
A. 适应自然，避其邪气
B. 饮食有节，谨和五味
C. 调摄精神，内养真气
D. 形与神俱，尽终天年
E. 劳逸结合，不可过劳

正确答案：D。形与神俱，尽终天年

解析：形与神俱，尽终天年是指如果按饮食有节，起居有常，不妄作劳的养生方法就可以达到的目的，不属于养生方法（D对）。自然界四时气候和昼夜晨昏等变化，必然影响人体，使之发生相应的生理和病理反应。只有顺应自然变化而摄生，才能保障健康，避免邪气侵害，减少疾病发生（A错）。饮食要有节制，养成良好的饮食习惯，提倡定时定量，不可过饥过饱，以免损伤胃肠功能（B错）。人体的情志活动与身体健康密切相关（C错）。劳逸适度，弛张结合。人需要一定的体力劳动，使气血流畅，促进身体健康。若劳逸失度则有损健康，过劳则耗伤气血，过逸又可致气血阻滞，均可引起疾病的发生（E错）。